拔除上颌第一磨牙麻醉的神经是
A. 鼻腭神经、腭前神经、腭后神经
B. 上牙槽后神经、上牙槽中神经、腭前神经
C. 上牙槽后神经、上牙槽中神经、鼻腭神经
D. 上牙槽后神经、上牙槽中神经、上牙槽前神经
E. 上牙槽中神经、鼻腭神经、腭前神经

正确答案：B。上牙槽后神经、上牙槽中神经、腭前神经

解析：本题考查上颌神经在口腔的分布。拔除上颌第一磨牙麻醉的神经是上牙槽后神经、上牙槽中神经、腭前神经（B对）。腭前神经分布于上颌345678的腭侧黏骨膜及牙龈；上牙槽后神经分布于上颌78的牙髓及上颌6的腭及远中颊根髓、牙周膜、牙槽骨、颊侧牙龈；上牙槽中神经分布于上颌45的牙髓及上颌6的近中颊根髓、牙周膜、牙槽骨、颊侧牙龈。